根据《中华人民共和国药品管理法》，用于灌装葡萄糖注射液液体的容器，必须符合
A. 药品标准
B. 企业标准
C. 行业标准
D. 药用要求
E. 卫生要求

正确答案：D。药用要求

解析：本题考查药品包装要求。根据《中华人民共和国药品管理法》，用于灌装葡萄糖注射液液体的容器，必须符合药用要求（D对）。《中华人民共和国药品管理法》第四十六条规定，直接接触药品的包装材料和容器，应当符合药用要求，符合保障人体健康、安全的标准。